《中华人民共和国药品管理法》规定，按劣药论处的是
A. 国务院药品监督管理部门规定禁止使用的
B. 超过有效期的
C. 不注明或者更改生产批号的
D. 变质、被污染的
E. 直接接触药品的包装材料和容器未经批准的

正确答案：B、C、E。超过有效期的；不注明或者更改生产批号的；直接接触药品的包装材料和容器未经批准的

解析：本题考查劣药。有下列情形之一的药品，按劣药论处：（一）未标明有效期或者更改有效期的；（二）不注明或者更改生产批号的（C对）；（三）超过有效期的（B对）；（四）直接接触药品的包装材料和容器未经批准的（E对）；（五）擅自添加着色剂、防腐剂、香料、矫味剂及辅料的；（六）其他不符合药品标准规定的。《中国人民共和国药品管理法》第四十八条规定，有下列情形之一的药品，按假药论处：（一）国务院药品监督管理部门规定禁止使用的（A错）；（二）依照本法必须批准而未经批准生产、进口，或者按照本法必须检验而未经检验即销售的；（三）变质的；（四）被污染的（D错）；（五）使用依照本法必须取得批准文号而未取得批准文号的原料药生产的；（六）所标明的适应症或者功能主治超出规定范围的。